与地高辛联用，可改善心功能不全患者自觉症状的中成药是
A. 木防己汤
B. 钩藤散
C. 半夏泻心汤
D. 六味地黄丸
E. 桂枝茯苓丸

正确答案：A。木防己汤

解析：本题考查的是中西药合理的联用例举。与地高辛联用，可改善心功能不全患者自觉症状的中成药是木防己汤（A对）。木防己汤、茯苓杏仁甘草汤、四逆汤等与强心药地高辛等联用，可以提高疗效和改善心功能不全患者的自觉症状。钩藤散（B错）与抗高血压药甲基多巴、卡托普利等联用可提高疗效。钩藤散、柴胡加龙骨牡蛎汤等与抗高血压药甲基多巴、卡托普利等联用，有利于提高对老年高血压的治疗效果。半夏泻心汤（C错）与治疗消化性溃疡的西药联用可提高疗效。具有抗应激作用的中药如柴胡桂枝汤、四逆散、半夏泻心汤等与治疗消化性溃疡的西药（H2受体拮抗剂，制酸剂）联用，可增强治疗效果。六味地黄丸（D错）与抗生素类药联用可增强疗效。清肺汤、竹叶石膏汤、竹茹温胆汤、六味地黄丸等与抗生素类药联用，有增强抗生素治疗呼吸系统反复感染效果的作用。桂枝茯苓丸（E错）与血管扩张药联用可增强疗效。桂枝茯苓丸、当归四逆加吴茱萸生姜汤等与血管扩张药联用，可增强作用，其中的中药方剂对于微循环系统的血管扩张特别有效。